医学伦理学的尊重原则主要包括以下几方面，除了
A. 尊重患者及其家属的自主权或决定
B. 尊重患者的一切主观意愿
C. 治疗要获得患者的知情同意
D. 保守患者的秘密
E. 保守患者的隐私

正确答案：B。尊重患者的一切主观意愿

解析：医学伦理学的尊重原则主要包括以下几方面：尊重患者及其家属的自主权或决定、治疗要获得患者的知情同意、保守患者的秘密、保守患者的隐私。患者自主权是有行为能力并处于医疗关系中的患者，在医患有沟通交流之后，经过深思熟虑，就有关自己疾病和健康间题做出合乎理性的决定，并据此采取负责的行动（B错，为本题正确答案）。尊重原则包括尊重患者的生命权、尊重患者的人格尊严、尊重患者的隐私、尊重患者的自主权（ACDE对）。